患者，男，77岁，因感冒、发热、咳嗽，自服酚麻美敏片、维C银翘片，三天后出现急性尿潴留。可引起该患者出现尿潴留的药物成分是
A. 对乙酰氨基酚
B. 维生素C
C. 银翘
D. 氯苯那敏
E. 右美沙芬

正确答案：D。氯苯那敏

解析：本题考查氯苯那敏。可引起该患者出现尿潴留的药物成分是氯苯那敏（D对）。酚麻美敏片含有氯苯那敏，氯苯那敏为抗过敏药。多数抗过敏药具有轻重不同的抗胆碱作用，尤其是第一代抗组胺药，表现为口干、视物模糊、便秘，对闭角型青光眼者可引起眼压增高，对患有良性前列腺增生症的老年男性可能引起尿潴留，给药时应予注意。